女，30岁。左手示指末节皮下感染5天，伴剧烈跳痛，肿胀明显，需切开引流。正确的切口应是
A. 经甲床切开
B. 经甲沟切开
C. 指末端鱼口状切开
D. 指侧面纵切口
E. 末节指腹横切口

正确答案：D。指侧面纵切口

解析：患者食指末节皮下感染后出现剧烈跳痛，肿胀明显，应诊断为脓性指头炎（为手指末节掌面的皮下化脓性细菌感染，多因甲沟炎加重或指尖、手指末节皮肤受伤后引起，感染后局部肿胀严重，脓肿不易破出）。手指末节感染灶剧烈跳痛、肿胀明显，需切开引流，正确的切口应是指侧面纵切口（应避免于掌侧做切口，防止局部瘢痕形成，影响指腹功能）（D对）。经甲床切开（A错）不利于指甲再生。经甲沟切开（P113）（B错）为甲沟炎的切口选择。指末端鱼口状切开（P113）（形成鱼嘴状指腹畸形）（C错）及末节指腹横切口（E错）术后易形成瘢痕，影响手指的功能。